属于免疫调节治疗类风湿关节炎的方法的是
A. 注射TNF-α
B. 注射LAK
C. 注射CTL
D. 注射肿瘤相关Ag疫苗
E. 注射McAb-125I

正确答案：A。注射TNF-α

解析：治疗用抗体：抗毒素血清主要用于治疗细菌外毒素所致疾病，如破伤风和白喉。抗TNF-α单克隆抗体可治疗类风湿关节炎。抗CD20单克隆抗体可治疗非霍奇金淋巴瘤；抗VEGF单克隆抗体可治疗转移性结肠直肠癌：抗IgE单克隆抗体可治疗持续性哮喘。掌握“免疫预防及免疫治疗”知识点。